视网膜上只有视锥细胞而无视杆细胞的区域是
A. 视网膜中央部分
B. 视神经乳头处
C. 中央凹
D. 视网膜周缘部分
E. 视神经盘

正确答案：C。中央凹

解析：黄斑中央凹为感光最敏锐处，原因是此区无血管，而且是只有视锥细胞而无视杆细胞的区域（C对）。